急性输卵管妊娠破裂或流产手术应遵循哪项原则
A. 尽快钳夹出血处，切除或保留患侧输卵管
B. 切除子宫
C. 进行对侧输卵管整形术
D. 切除患侧附件
E. 尽量吸出腹腔血液作自体输血

正确答案：A。尽快钳夹出血处，切除或保留患侧输卵管

解析：可以根据患者的情况，可以切除，也可以适度修补，保留。尽快钳夹出血处，切除或保留患侧输卵管，此为急性输卵管妊娠破裂或流产手术应遵循的原则。B项切除子宫（患者还要有生育要求，且还没有达到切除子宫的指征）C项进行对侧输卵管整形术（没有意义）D项切除患侧附件（视具体病情而定）E项尽量吸出腹腔血液作自体输血（腹腔血液进行自体输血应符合以下条件：妊娠＜12周、胎膜未破、出血时间＜24小时、血液未受污染、镜下红细胞破坏率＜30%）。掌握“异位妊娠”知识点。